心肌肥大能发挥代偿作用哪项除外
A. 增加心脏的收缩力
B. 降低室壁张力
C. 心率加快增加心输出量
D. 降低心肌耗氧量
E. 减轻心脏负担

正确答案：C。心率加快增加心输出量

解析：长期存在心肌损伤或负荷增加时，心脏通过慢性综合性适应性反应即心室重塑进行代偿。心室重塑包括心肌细胞重塑和心肌间质重塑，心肌细胞重塑又分为心肌肥大和心肌细胞表型改变。心肌肥大表现为心室壁增厚，后者可以降低室壁张力（B错），进而降低心肌耗氧量（D错），减轻心脏负担（E错）。另外，虽然心肌肥大会引起单位重量心肌收缩性的降低，但其也会引起心脏总重量增加，所以心脏的收缩力增加（A错）。综上所述，心肌肥大通过降低心肌耗氧、增加心脏收缩力而不是加快心率（C对）发挥代偿作用。